在两种不同的情况下，A情况的发病率显著高于B情况，且A情况有某因素存在，B情况没有该因素，则该因素可能是该病的病因
A. 求同法
B. 求异法
C. 共变法
D. 类推法
E. 假说

正确答案：B。求异法

解析：本题考查求异法。求异法针对的是在不同情况的不同群体之间寻找不同点。在两种不同的情况下，A情况的发病率显著高于B情况，且A情况有某因素存在，B情况没有该因素，则该因素即是A和B两个不同群体的不同点，即可能是该病的病因。该方法属于求异法（B对ACDE错）。